衡量健康生命损失情况的单位，用年数表示，将早死导致的健康生命年损失和残疾导致的健康生命年损失结合起来，构成生命数量和生活质量以时间为单位的综合性指标指的是
A. 减寿人年数
B. 无残疾期望寿命
C. 活动期望寿命
D. 伤残调整生命年
E. 健康期望寿命

正确答案：D。伤残调整生命年